围绝经综合征血管舒缩症状主要表现为
A. 失眠
B. 潮热
C. 月经紊乱
D. 耳鸣
E. 头痛

正确答案：B。潮热